患者，男，30岁，症见午后低热月余不退，盗汗，口渴，形体消瘦，肢蒸心烦，脉沉细略数，舌润红苔少。治宜选用
A. 清营汤
B. 黄连解毒汤
C. 小柴胡汤
D. 清骨散
E. 蒿芩清胆汤

正确答案：D。清骨散

解析：题中患者午后低热，盗汗，诊断为内伤发热，口渴，心烦，消瘦，脉沉细数属虚证，为阴虚阳盛，虚火内炽所致，治宜滋阴清热，方用清骨散（D对）。清营汤清营解毒，透热养阴，主治热入营分证（A错）。黄连解毒汤泻火解毒，主治一切实热火毒，三焦热盛之证（B错）。小柴胡汤适用于伤寒少阳证，妇人伤寒，热入血室，以及疟疾、黄疸与内伤杂病而见少阳证者（C错）。蒿芩清胆汤清胆利湿，和胃化痰，主治少阳湿热痰浊证（E错）。